男，58岁。反复上腹痛20年，近2个月出现进食后腹胀，恶心，呕吐隔夜宿食，体重减轻15kg。为明确诊断，应首选的检查方法是
A. 腹部CT
B. 腹部B型超声
C. 立位腹部透视
D. 胃镜
E. 腹部ECT

正确答案：D。胃镜

解析：中年男性患者，反复上腹痛20年（提示消化性溃疡），近2个月出现进食后腹胀，恶心，呕吐隔夜宿食（提示幽门梗阻），结合患者病史和体查，应考虑为消化性溃疡合并幽门梗阻。为明确诊断，应首选的检查方法是纤维胃镜检查（D对）。纤维胃镜可以直接观察到狭窄、不规则的幽门，同时还可进行活组织病理检查以排除肿瘤。腹部CT（A错）、腹部B型超声（B错）、立位腹部透视（C错）对腹部空腔脏器的显示效果不佳，一般不用于幽门梗阻的诊断。幽门梗阻时由于钡剂很难通过且不易经胃管吸出，因此一般不选择全消化道钡餐造影。腹部ECT（E错）主要用于恶性肿瘤骨转移的诊断，对胃肠道疾病敏感性低。